与糖尿病性牙周炎关系密切的全身因素是
A. 白细胞数目略增高
B. 白细胞趋化功能缺陷
C. 单核细胞数目略增高
D. 转氨酶水平升高
E. 血压不稳定

正确答案：B。白细胞趋化功能缺陷

解析：糖尿病伴发牙周病的病理机制可能是白细胞趋化和吞噬功能缺陷、组织内血管基底膜的改变、胶原合成减少、骨基质形成减少，以及免疫调节能力下降，使患者的抗感染能力下降、伤口愈合障碍。近年来发现，糖化末端产物（AGES）与其细胞受体（MGE）作用的加强是糖尿病患者牙周病加重的机制。掌握“牙周疾病促进因素”知识点。